巨大帽状腱膜下血肿处理原则
A. 热敷
B. 冷敷
C. 预防感染
D. 抽吸后加压包扎
E. 切开引流

正确答案：D。抽吸后加压包扎

解析：巨大帽状腱膜下血肿可引起贫血甚至休克，其处理原则是尽快抽吸后加压包扎（D对）。穿刺抽吸前须进行严格皮肤准备和消毒以预防感染（C错）。头皮血肿早期可采用局部冷敷（B错），以促使血管收缩，减少局部出血与渗出，24小时后可采用热敷（A错），以促进血肿的吸收，但均用于较小的血肿。切开引流（E错）适用于已有感染的头皮血肿。